肋脊点和肋腰点压痛可见于
A. 膀胱炎
B. 急性肾盂肾炎
C. 尿道炎
D. 输尿管结石
E. 输卵管炎

正确答案：B。急性肾盂肾炎

解析：患者有腰痛，多为钝痛或酸痛，程度不一，少数有腹部绞痛，沿输尿管向膀胱方向放射；体检时在上输尿管点（腹直肌外缘与脐平线交叉点）或肋腰点（腰大肌外缘与十二肋交叉点）有压痛，肾区叩痛阳性（B对）。急性膀胱炎常突然起病，排尿时尿道有烧灼痛，尿频，往往伴尿急，严重时类似尿失禁，尿频尿急常特别明显，每小时可达5～6次以上，每次尿量不多，甚至只有几滴，排尿终末可有下腹部疼痛。尿液混浊，有时出现血尿，常在终末期明显。耻骨上膀胱区有轻度压痛（A错）。尿道炎表现为尿频、尿痛、尿急和血尿，急性期男性可有尿道分泌物，初始为黏液性，后多有脓性分泌物；女性则少有分泌物，转为慢性时表现为尿道刺痛和排尿不适，尿道分泌物减少，呈稀薄浆液状，急性发作时耻骨上区和会阴部有钝痛，可见尿道口发红，有分泌物（C错）。输尿管结石通常伴有明显的症状，如肾绞痛、血尿，输尿管结石还常造成梗阻和肾积水（D错）。输卵管炎轻者无症状或者症状轻微。常见为下腹痛、发热、阴道分泌物增多。腹痛为持续性、活动或性交后加重（E错）。